肛管直肠癌的早期症状除便血外，还可见
A. 大便变形
B. 腹胀肠鸣
C. 脱出不纳
D. 排便习惯改变
E. 肛门潮湿

正确答案：D。排便习惯改变

解析：肛管直肠癌的早期症状有便血、排便习惯改变（D对）。